圣愈汤治疗痛经的适应证是
A. 气血虚弱
B. 肾亏损
C. 心肝血虚
D. 血虚气滞
E. 气滞血瘀

正确答案：A。气血虚弱

解析：圣愈汤的功效为补气，补血，摄血。主治：气血虚弱之证（A对）。肾亏虚，肾精不足，无以濡养冲任，不荣则痛，治疗当补肾益精，养血止痛，方用益肾调经汤（B错）。心肝血虚，阴血不足，不荣则痛，治疗当补血调肝（C错）。血虚气滞为干扰选项（D错）。气滞血瘀，瘀阻冲任，不通则痛，治疗当理气行滞，化瘀止痛，方用膈下逐瘀汤（E错）。